男，62岁。半日前进食苹果后呕鲜血约300ml，随后排黑便约400g。慢性乙型肝炎病史30余年。查体：P112次/分，BP100/60mmHg。神志清楚，腹软，无压痛，肠鸣音12次/分。该患者消化道出血最有可能的原因是
A. 糜烂性胃炎
B. 食管贲门黏膜撕裂综合征
C. 胃癌
D. 消化性溃疡
E. 胃底静脉曲张破裂

正确答案：E。胃底静脉曲张破裂

解析：男，62岁，半日前进食苹果后（进食粗糙食物是食管胃底静脉曲张破裂出血诱因）呕鲜血约300ml，随后排黑便约400g（呕血、黑便是上消化道出血的特征表现）。慢性乙型肝炎病史30余年（乙型肝炎病毒感染为肝硬化最常见原因）。查体：P112次/分（正常值60～100次/分），BP100/60mmHg（正常值收缩压为90～120mmHg，舒张压为60～80mmHg）。神志清楚，腹软，无压痛，肠鸣音12次/分（肠鸣音亢进，支持消化道出血的诊断），综上，考虑该患者消化道出血最有可能的原因是肝硬化后胃底静脉曲张破裂（E对）（P408）。糜烂性胃炎（A错）、胃癌（C错）和消化性溃疡（D错）亦是上消化道出血最常见的病因，但该患者缺少相关病因或诱因（P450）。食管贲门黏膜撕裂综合征（B错）主要是腹内压力或胃内压力骤然升高如恶心呕吐、内镜检查、剧烈咳嗽，导致食管下端和胃连接处的黏膜撕裂，并发上消化道出血（该患者无相关病因）。